下面关于胃的说法，正确的是
A. 分为大弯、小弯、贲门和幽门四部
B. 分为胃体、胃底、贲门部和幽门部四部
C. 分为胃体、胃底、幽门窦和幽门管四部
D. 临床上幽门窦称为胃窦
E. 临床上幽门管称为胃窦

正确答案：B。分为胃体、胃底、贲门部和幽门部四部

解析：胃分为胃体、胃底、贲门部和幽门部四部(B对)，临床上将幽门部称为胃窦。